某女，48岁，平素易外感。昨日受凉后发热，恶寒明显，头痛，鼻塞，身痛，体倦，咳嗽，舌质淡，苔薄白，脉浮无力。应选用的方剂是
A. 银翘散加减
B. 参苏饮加减
C. 桑菊饮加减
D. 麻黄汤加减
E. 桂枝汤加减

正确答案：B。参苏饮加减

解析：本题考查的是感冒的辨证论治。平素易外感。昨日受凉后发热，恶寒明显，头痛，鼻塞，身痛，体倦，咳嗽，舌质淡，苔薄白，脉浮无力。应选用的方剂是参苏饮加减（B对）。感冒是感受风邪或时行病毒，卫表失和而导致的常见外感疾病，临床表现以鼻塞、流涕、喷嚏、头痛、恶寒、发热、全身不适、脉浮等为特征。西医学中普通感冒（伤风）、流行性感冒（时行感冒）及其他上呼吸道感染，有上述临床表现者可参考此内容辨证论治。（一）风寒感冒：【症状】恶寒重，发热轻，无汗头痛，肢体酸痛，或鼻塞声重，或鼻痒喷嚏，流涕清稀，咽痒，咳嗽，咳痰稀白。舌苔薄白，脉浮紧。【方剂应用】基础方剂为：荆防败毒散（荆芥、防风、前胡、柴胡、羌活、独活、川芎、茯苓、枳壳、桔梗、甘草）加减。（二）风热感冒：【症状】身热较著，微恶风，头胀痛，或咳嗽少痰，或痰出不爽，咽痛咽红，口渴。舌边尖红，苔薄白或微黄，脉浮数。【方剂应用】基础方剂为：银翘散（金银花、连翘、竹叶、荆芥、牛蒡子、薄荷、桔梗、淡豆豉、甘草）加减（A错）。（三）时行感冒：【症状】突然发热，高热不退，甚则寒战，周身酸痛，无汗，咳嗽，口干，咽喉疼痛，伴明显全身症状，呈现流行性发作。舌红，苔黄，脉浮数。【方剂应用】基础方剂为：清瘟败毒饮（石膏、生地、犀角、栀子、丹皮、黄连、桔梗、黄芩、知母、赤芍、玄参、连翘、竹叶、甘草）加减。（四）气虚感冒：【症状】发热，恶寒较甚，无汗，头痛鼻塞，身楚倦怠，咳嗽，痰白，咳痰无力。舌淡，苔白，脉浮而无力。【方剂应用】基础方剂为：参苏饮（人参、苏叶、甘草、茯苓、葛根、前胡、半夏、枳壳、桔梗、陈皮、木香）加减。桑菊饮加减（C错）为咳嗽风热犯肺证的方剂应用。咳嗽风热犯肺证：【症状】咳嗽频剧，气粗，或咳声嗄哑，咳痰不爽，痰黏稠或稠黄，喉燥咽痛，口渴，鼻流黄涕，头痛，肢楚，恶风身热。舌边尖红，苔薄黄，脉浮数。【方剂应用】基础方剂为桑菊饮（桑叶、苦杏仁、芦根、菊花、甘草、连翘、薄荷、桔梗）加减。麻黄汤加减（D错）为喘证风寒闭肺证的方剂应用。喘证风寒闭肺证：【症状】喘咳气逆，呼吸急促，胸部胀闷，痰多色白稀薄而带泡沫，兼头痛鼻塞、无汗、恶寒、发热，舌苔薄白而滑，脉浮紧。【方剂应用】基础方剂为麻黄汤（麻黄、杏仁、桂枝、炙甘草）合华盖散（麻黄、杏仁、桑白皮、紫苏子、茯苓、陈皮）加减。方剂应用为桂枝汤加减（E错）的病证，2022年考试指南未明确说明。桂枝汤为解表剂，具有辛温解表，解肌发表，调和营卫之功效。主治头痛发热，汗出恶风，鼻鸣干呕，苔白不渴，脉浮缓或浮弱者。临床常用于治疗感冒、流行性感冒、原因不明的低热、产后或病后低热、妊娠呕吐、多形红斑、冻疮、荨麻疹等属于营卫不和者。